表面麻醉时，最常选用的麻醉药是
A. 布比卡因
B. 普鲁卡因
C. 利多卡因
D. 地卡因
E. 卡波卡因

正确答案：D。地卡因

解析：本题考查局麻药。地卡因（D对）又称丁卡因，是酯类长效局麻药，脂溶性高，穿透力强，麻醉强度是普鲁卡因的10倍，是最常用的表面麻醉药物。普鲁卡因（B错）弥散能力差，不适合表面麻醉。利多卡因（C错）、布比卡因（A错）、卡波卡因（又称甲哌卡因）（E错），有较强的组织穿透性和扩散性，主要用作神经传导阻滞麻醉，也可用作表面麻醉，但不如地卡因常用。